无牙颌患者种植体周围菌斑中的细菌主要是
A. 中间普氏菌、螺旋体
B. 中间普氏菌、具核梭杆菌
C. 牙龈卟啉单胞菌、具核梭杆菌
D. 牙龈卟啉单胞菌、螺旋体
E. 牙龈卟啉单胞菌、中间普氏菌、螺旋体、具核梭杆菌

正确答案：B。中间普氏菌、具核梭杆菌

解析：本题考查无牙颌患者种植体周围菌斑中的细菌。无牙颌患者种植体周围菌斑中细菌主要是中间普氏菌、核梭杆菌（B对），菌斑组成更接近健康牙周的菌斑。牙龈卟啉单胞菌、螺旋体（D错）等牙周致病因素常见于部分缺牙患者菌斑中。牙龈卟啉单胞菌是慢性牙周炎的致病因素，中间普氏菌是妊娠期龈炎的致病因素，螺旋体、核梭杆菌（ACE错）是急性坏死性牙龈炎的致病因素。